55岁女性，绝经3年，近半年偶有性生活后阴道少量流血，无腹痛等其他不适症状。到医院检查发现HPV阳性。该妇女最有必要进行的检查是
A. B超检查
B. 宫颈细胞学检查
C. 阴道镜检查
D. 分段诊刮检查
E. 血清CA125测定

正确答案：B。宫颈细胞学检查

解析：本题考查宫颈癌的检查方法。目前研究证实，人类乳头瘤病毒（HPV）是引起宫颈癌发生的主要致病病毒。宫颈细胞学检查（B对ACDE错）方法是目前国际上最先进的一种宫颈癌细胞学检查技术，其现在常用的是TCT检查，是采用液基薄层细胞检测系统检测宫颈细胞并进行细胞学分类诊断。